男，35岁。反复上腹痛5年，再发1个月，加重2天，5年来反复上腹痛，多发生于饥饿时，进食及口服碱性药可缓解，1个月来再发上腹痛，口服碱性药物缓解不满意，2天来上腹痛加重向后背放射，查体：上腹部压痛。血清淀粉酶320U/L，该患者最可能的诊断是
A. 十二指肠球前壁溃疡
B. 胃窦溃疡
C. 胃底溃疡
D. 胃体溃疡
E. 十二指肠球后壁溃疡

正确答案：E。十二指肠球后壁溃疡

解析：患者青年男性，反复上腹痛5年，再发1个月，加重2天，5年来反复上腹痛（考虑上消化道疾病），多发生于饥饿时，进食及口服碱性药可缓解，诊断为十二指肠溃疡。1个月来再发上腹痛，口服碱性药物缓解不满意，2天来上腹痛加重向后背放射（可能后壁穿透入胰腺），最可能诊断为十二指肠后壁溃疡（E对）。查体：上腹部压痛。血清淀粉酶320U/L（正常值40～110U/L，升高提示胰腺损伤）。胃部溃疡（BCD错）表现为餐后痛。十二指肠球前壁溃疡（A错）一般不会表现为上腹痛向后背放射。